尿道球腺开口于
A. 尿道前列腺部
B. 尿道膜部
C. 尿道海绵体部
D. 尿道球部
E. 阴茎头部的尿道

正确答案：D。尿道球部

解析：尿道球部（D对）为尿道球腺的开口处，是尿道海绵体内的尿道最宽处。